参与黏膜免疫的免疫球蛋白是
A. IgA
B. IgM
C. IgD
D. IgE
E. IgG

正确答案：A。IgA

解析：人体免疫球蛋白主要分为IgM、IgA、IgD、IgE、IgG，其中，IgA的功能是参与黏膜免疫（A对），通过与相应病原微生物（细菌、病毒等）结合，阻止病原体粘附到细胞表面，从而在抗感染中发挥重要作用，且SIgA在黏膜表面也有中和毒素的作用，是机体抗感染的“边防军”。IgM（B错）（P36）的功能是参与体液免疫的早期应答和进行早期防御，是机体抗感染的“先头部队”。IgD（C错）（P37）血清IgD的生物学功能尚不清楚，膜结合型IgD构成BCR，是B细胞分化发育成熟的标志。IgE（D错）（P37）的功能是参与Ⅰ型超敏反应和抗寄生虫反应。IgG（E错）（P35）的功能是参与体液免疫的再次应答和抗感染的作用，是机体抗感染的“主力军”，也是唯一一个可以通过血胎屏障的免疫球蛋白。